多糖结构中含有单糖分子的个数是
A. 7-9个
B. 10个以上
C. 5-6个
D. 3-4个
E. 1-2个

正确答案：B。10个以上

解析：本题考查糖的分类。多糖结构中含有单糖分子的个数是10个以上（B对）。多聚糖又称多糖，由10个以上的单糖分子通过苷键聚合而成，分子量较大，一般由几百个至几千个单糖分子组成。多糖基本没有单糖的性质，一般无甜味，也无还原性。糖类化合物可根据其能否被水解和水解后生成单糖的数目分为单糖、低聚糖、多聚糖三类。单糖是组成糖类及其衍生物的基本单元，也是不能再水解的最简单的糖，如葡萄糖、鼠李糖等。低聚糖也称为寡糖，由2～9个单糖聚合而成，如蔗糖、芸香糖等。多聚糖是一类由10个以上单糖聚合而成的高分子化合物，通常由几百甚至几千个单糖组成，如淀粉、纤维素等。多糖分子量很大，其性质也明显不同于单糖和低聚糖。